老年人动脉硬化时
A. 收缩压升高
B. 舒张压升高
C. 收缩压和舒张压升高幅度相同
D. 收缩压降低，舒张压升高
E. 收缩压升高，舒张压降低

正确答案：E。收缩压升高，舒张压降低